因导致严重血糖紊乱而撤出美国和加拿大市场的药品是
A. 罗非昔布
B. 西沙必利
C. 苯丙醇胺
D. 西立伐他汀
E. 加替沙星

正确答案：E。加替沙星

解析：本题考查药物的不良反应。因导致严重血糖紊乱而撤出美国和加拿大市场的药品是加替沙星（E对）。加替沙星的不良反应主要为血糖异常，血糖异常不良反应表现为高血糖反应、低血糖反应和血糖紊乱。罗非昔布（A错）的不良反应主要为胃肠道反应和凝血障碍。西沙必利（B错）的不良反应主要为腹部痉挛、肠鸣和腹泻。苯丙醇胺（C错）的不良反应主要为高血压反应、失眠等。西立伐他汀（D错）的不良反应主要是头痛、胃肠不适。